症见咳嗽，少痰，痰中带血，潮热盗汗及身体逐渐消瘦，口燥咽干，胸闷隐痛，舌红少苔，脉细数。其诊断为下列何病
A. 肺痿
B. 肺胀
C. 肺痨
D. 虚劳
E. 咳血

正确答案：C。肺痨

解析：咳嗽，少痰，痰中带血，胸闷隐痛，可诊断为肺痨；阴虚火旺则潮热盗汗及身体逐渐消瘦；阴虚津不上承，故见口燥咽干；舌红少苔，脉细数，均为痨虫损肺，肺阴亏损所致（C对）。肺痿（A错）以咳唾涎沫为主要症状。肺胀（B错）以胸中胀闷，咳嗽咳痰，气短而喘为主要表现。虚劳（D错）是以五脏虚证为主要临床表现的多种慢性虚弱症候的总称。咳血（E错）以咳嗽出血，痰少血多，或大量咯吐鲜血为主要表现。